浸渍法宜选用的温度为
A. 常温
B. 高温
C. 超高温
D. 低温
E. 超低温

正确答案：A。常温

解析：本题考查的是浸渍法。浸渍法宜选用的温度为常温（A对）。浸渍法：是在常温或温热（60℃～80℃）条件下用适当的溶剂浸渍药材以溶出其中有效成分的方法。本法适用于有效成分遇热不稳定的或含大量淀粉、树胶、果胶、黏液质的中药的提取。但本法出膏率低，需要特别注意的是当水为溶剂时，其提取液易于发霉变质，需注意加入适当的防腐剂。